男，32岁。活动后心悸、胸痛、喘息2月余。其兄24岁时猝死。查体：P78次/分，BP105/75mmHg，双肺呼吸音清，胸骨左缘第4肋间可闻及3/6级收缩期喷射样杂音。胸部X线片示心脏外形大致正常。该患者最可能的诊断是
A. 风湿性心脏瓣膜病
B. 房间隔缺损
C. 肥厚型心肌病
D. 限制型心肌病
E. 冠心病

正确答案：C。肥厚型心肌病

解析：患者青年男性，活动后心悸、胸痛、喘息，其兄24岁时猝死（肥厚型心肌病是青少年运动猝死的最主要原因之一，并具有遗传异质性），胸骨左缘第4肋间可闻及3/6级收缩期喷射样杂音（提示流出道梗阻），胸部X线片示心脏外形大致正常（肥厚型心肌病X线检查示心影可以正常大小或左心室增大），综合患者的临床表现、体查和心电图检查，该患者最可能的诊断是肥厚型心肌病（C对）。风湿性心脏瓣膜病（P285）（A错）患者多有风湿热病史，且多在年幼时发病，并伴有相应瓣膜区的改变。房间隔缺损（B错）是临床上常见的先天性心脏畸形，典型表现为胸骨左缘第2、3肋间闻及Ⅱ～Ⅲ级收缩期吹风样杂音，伴有第二心音亢进和固定分裂，由于心房水平存在分流，可表现为右心室肥大。限制型心肌病（P269）（D错）是以心室壁僵硬增加、舒张功能降低、充盈受限而产生临床右心衰症状为特征的一类心肌病，体格检查可见颈静脉怒张，通常伴有双心房扩大。冠心病（P218）（E错）指冠状动脉发生粥样硬化引起管腔狭窄或闭塞，导致心肌缺血缺氧或坏死，多见于40岁以上中、老年人，急剧的、暂时的缺血缺氧引起心绞痛，无胸骨左缘第4肋间可闻及3/6级收缩期喷射样杂音。